不依赖Na的转运葡萄糖载体
A. DG
B. Na⁺-K⁺-ATP酶
C. 线粒体内膜嵴
D. FFO复合体
E. GLUT4

正确答案：E。GLUT4